下列哪种检查不适合于口腔颌面部深部脓肿的诊断
A. 波动试验
B. 压痛点检查
C. 穿刺法
D. B型超声波
E. CT

正确答案：A。波动试验

解析：本题考查口腔颌面部深部脓肿的诊断。波动试验是临床上诊断浅部脓肿的主要方法（A错，为本题的正确答案），深部脓肿，尤其是筋膜下层的脓肿，位置深在，一般很难查到波动感。口腔颌面部深部脓肿的诊断方法包括：①压痛点检查（B对），按压脓肿区的表面皮肤常出现不能很快恢复的凹陷性水肿；②为了确定有无脓肿或脓肿的部位，可用穿刺法（C对）以协助诊断；③必要时借助B型超声波（D对）或CT（E对）行辅助检查与诊断，明确脓肿的部位及大小；④进行脓液的涂片及细菌培养可确定细菌种类等。